在临床医学研究中，可以获得意外损伤赔偿的是
A. 可预见的不良反应可以获得赔偿
B. 死亡者家属有权获得赔偿
C. 因参加试验而意外受损伤者有权力要求获得高额赔偿
D. 死亡者家属是无权力要求获得赔偿的
E. 对可预见的不良反应可以酌情给予赔偿

正确答案：B。死亡者家属有权获得赔偿